胰岛素分泌相对不足的是
A. 1型糖尿病
B. 妊娠糖尿病
C. 2型糖尿病
D. 遗传缺陷糖尿病
E. 免疫介导糖尿病

正确答案：C。2型糖尿病

解析：本题考查2型糖尿病。2型糖尿病（C对）胰岛素分泌相对不足。1型糖尿病（A错）为胰岛素依赖型糖尿病，因为胰岛B细胞破坏，胰岛素绝对缺乏导致。遗传缺陷糖尿病（D错）为特殊类型的糖尿病。妊娠糖尿病（B错）是妊娠过程中初次发现的任何程度的糖耐量异常。免疫介导糖尿病（E错）是因免疫异常导致自身β细胞减少而导致的糖尿病。